关于香豆素类抗凝血药，哪项错误
A. 发挥作用慢，维持时间长
B. 维生素K能对抗其抗凝血作用
C. 体内外都有抗凝血作用
D. 口服就有抗凝血作用
E. 华法林的作用比双香豆素出现作用快，维持时间短

正确答案：C。体内外都有抗凝血作用